关于受精下列哪项描述是正确的
A. 受精过程约需8小时
B. 着床约在受精后11～12天开始
C. 精子和卵子的结合过程称受精
D. 受精第8天，形成早期胚泡
E. 受精后第8天，形成晚期胚泡

正确答案：C。精子和卵子的结合过程称受精

解析：受精后第4日进入宫腔形成早期胚泡。受精后第5～6日早期胚泡透明带消失，继续分裂发育形成“晚期囊胚”。受精后第6～7日，晚期胚泡透明带消失后逐渐埋入子宫内膜并被其覆盖的过程称为受精卵着床（植入）。卵巢排出的卵子（次级卵母细胞）在输卵管壶腹部与峡部连接处与精子结合，其过程称为受精，整个过程约需24小时。掌握“妊娠生理”知识点。